全口义齿后牙选用无尖牙的优点不包括
A. 侧向力小
B. 有利于义齿的稳定
C. 容易达到平衡牙合
D. 对牙槽嵴损害小
E. 咀嚼效率低

正确答案：E。咀嚼效率低

解析：本题考查非解剖式牙的优点。无尖牙的牙尖斜度为0，即非解剖式牙，无法与对颌形成牙尖交错的紧密咬合，其咀嚼效能较解剖式牙低（E错，为本题的正确答案），是其缺点之一。由于其牙尖斜度为0，其侧向力较解剖式牙明显减小（A对），同时可减少由侧向力造成的义齿不稳定（B对），使（牙合）力以垂直方向向牙槽嵴传导，对牙槽嵴的损害小（D对）。排牙时操作较简单，容易达到平衡（牙合）（C对）。